下列除哪项外，均可选择胸部X线检查进行鉴别
A. 胸腔积液是血性或脓性
B. 大叶性肺炎或支气管肺炎
C. 气胸或肺大泡
D. 肺不张或肺实变
E. 肺脓肿或肺肿瘤

正确答案：A。胸腔积液是血性或脓性

解析：X线仅能显示胸腔积液的位置及量，并不能辨别其性质为血性或脓性（A对）。大叶性肺炎常累及一个或多个完整的肺叶，小叶性肺炎病变范围是小叶性的，X线片中大叶性肺炎为大片状实变影，小叶性肺炎变现为多发散在斑片状影，可予以鉴别（B错）。气胸时，气胸区呈线状或带状无纹理区，可见被压缩肺的边缘，肺大泡为肺内空腔，可见完整类圆形无纹理区，轮廓较清（C错）。肺不张时，不张肺叶缩小，密度均匀增高，纵膈可不同程度向患侧移位，而肺实变时多形成单一的片状致密影或多灶性致密影，实变中心密度较高，边缘区常较淡（D错）。肺脓肿病灶早期呈肺内致密的团状影，其后形成厚壁空洞，其内缘常较光整，底部常见气—液平面，而肺肿瘤常为厚壁偏心空洞，内壁不光整，可有壁结节，外壁可有分叶征及毛刺征（E错）。